最易形成潜伏感染的病毒是
A. 麻疹病毒
B. 流感病毒
C. 狂犬病
D. 脊髓灰质炎
E. 水痘﹣带状疱疹病毒

正确答案：E。水痘﹣带状疱疹病毒